以下有关唇的血液供应与淋巴回流描述中，不恰当的是
A. 静脉血经面静脉回流
B. 主要来自面动脉分支的上、下唇动脉
C. 唇的淋巴管很丰富
D. 上唇及下唇外侧部的淋巴管注入颏下淋巴结
E. 下唇外1/3的淋巴管还可通过颏孔进入下颌骨

正确答案：D。上唇及下唇外侧部的淋巴管注入颏下淋巴结

解析：唇的血液供应与淋巴回流：主要来自面动脉分支的上、下唇动脉，静脉血经面静脉回流。唇的淋巴管丰富，上唇及下唇外侧部的淋巴管注入下颌下淋巴结；上唇的淋巴管有时可注入耳前淋巴结或颈深上淋巴结。下唇中部的淋巴管注入颏下淋巴结；下唇中线或近中线的淋巴管有时交叉至对侧的下颌下淋巴结；下唇外1/3的淋巴管还可通过颏孔进入下颌骨。掌握“口腔境界及唇、颊的局部解剖”知识点。